主治脾虚寒湿气滞应首选的方剂是
A. 枳实消痞丸
B. 半夏厚朴汤
C. 厚朴温中汤
D. 理中丸
E. 平胃散

正确答案：C。厚朴温中汤

解析：脾虚寒湿气滞证即脾阳虚，寒湿内生，阻滞气机，故当治以温中散寒，祛湿，行气。厚朴温中汤中厚朴辛苦温燥，行气燥湿除满为君药。草豆蔻辛温芳香，温中散寒，燥湿运脾为臣药。陈皮、木香行气宽中，助厚朴消胀除满；干姜、生姜温脾暖胃，助草豆蔻散寒止痛； 茯苓渗湿健脾，均为佐药。甘草益气和中，调和诸药，功兼佐使。诸药共奏行气除满，温中燥湿之功，主治脾胃寒湿气滞证（C对）。枳实消痞丸功用为消痞除满，健脾和胃，主治脾虚气滞，寒热互结证（A错）。半夏厚朴汤功用为行气散结，降逆化痰，主治梅核气（B错）。理中丸功用为温中祛寒，补气健脾（D错）。平胃散功用为燥湿运脾，行气和胃，主治湿滞脾胃证（E错）。